视神经盘（视神经乳头）
A. 在眼球的后极
B. 有视网膜中央动脉穿过
C. 为光敏感区
D. 在黄斑的外侧
E. 此处由视网膜3层细胞组成

正确答案：B。有视网膜中央动脉穿过

解析：视神经盘在眼球后部偏颞侧，而非眼球的后极（A错），在黄斑的内侧，而非黄斑的外侧（D错），有视网膜中央动脉穿过（B对），此处因无感光细胞分布，故该处的视网膜仅有2层细胞组成，而非3层（E错）。光敏感区（C错）是黄斑，而非视神经盘。